某男，73岁。元旦与家人一起游园，次日发热，体温37.5℃，症见头痛鼻塞，咳嗽痰多，胸闷，呕逆，乏力，气短；舌胖淡，苔薄白，脉虚。宜选用的中成药是
A. 连花清瘟胶囊
B. 柴银口服液
C. 桑菊感冒片
D. 感冒清热颗粒
E. 参苏丸

正确答案：E。参苏丸

解析：本题考查的是感冒的辨证论治。元旦与家人一起游园，次日发热，体温37.5℃，症见头痛鼻塞，咳嗽痰多，胸闷，呕逆，乏力，气短；舌胖淡，苔薄白，脉虚。宜选用的中成药是参苏丸（E对）。感冒是感受风邪或时行病毒，卫表失和而导致的常见外感疾病，临床表现以鼻塞、流涕、喷嚏、头痛、恶寒、发热、全身不适、脉浮等为特征。西医学中普通感冒（伤风）、流行性感冒（时行感冒）及其他上呼吸道感染，有上述临床表现者可参考此内容辨证论治。（一）风寒感冒：【症状】恶寒重，发热轻，无汗头痛，肢体酸痛，或鼻塞声重，或鼻痒喷嚏，流涕清稀，咽痒，咳嗽，咳痰稀白。舌苔薄白，脉浮紧。【中成药应用】常用中成药有荆防颗粒、感冒清热颗粒（D错）、感冒软胶囊、九味羌活丸、葛根汤颗粒。（二）风热感冒：【症状】身热较著，微恶风，头胀痛，或咳嗽少痰，或痰出不爽，咽痛咽红，口渴。舌边尖红，苔薄白或微黄，脉浮数。【中成药应用】常用中成药有银翘解毒丸、双黄连口服液、桑菊感冒片（C错）、感冒清胶囊、柴银口服液（B错）。（三）时行感冒：【症状】突然发热，高热不退，甚则寒战，周身酸痛，无汗，咳嗽，口干，咽喉疼痛，伴明显全身症状，呈现流行性发作。舌红，苔黄，脉浮数。【中成药应用】常用中成药有清瘟解毒片、连花清瘟胶囊（A错）、维C银翘片、银翘伤风胶囊。（四）气虚感冒：【症状】发热，恶寒较甚，无汗，头痛鼻塞，身楚倦怠，咳嗽，痰白，咳痰无力。舌淡，苔白，脉浮而无力。【中成药应用】常用中成药有参苏丸（E错）、败毒散。